皮疹高出皮肤，时现时隐，搔之连片，此为
A. 阳斑
B. 阴斑
C. 麻疹
D. 风疹
E. 癮疹

正确答案：E。癮疹

解析：瘾疹是一种皮肤出现红色或苍白风团，时隐时现的瘙痒性、过敏性皮肤病。相当于西医的荨麻疹。（E对）。阳斑（A错）表现为斑点成片，或红或紫，平铺皮下。阴斑（B错）表现为斑点大小不一，色淡红或紫暗，隐隐稀少，发无定处，但不见于面、背部，出没无常。麻疹（C错）表现为出疹前先有发热恶寒，咳嗽喷嚏，鼻流清涕，眼泪汪汪，耳根冰冷，或耳后有红丝出现，3～4日疹点出现于皮肤，从头面到胸腹四肢，色如桃红，形如麻粒，尖而稀疏，抚之触手，逐渐稠密，2-5日出全，然后按出疹顺序逐渐回隐，留下棕褐色斑状色素沉着，并有糠麸样脱屑。风疹（D错）初起类似感冒，发热1～2天后，皮肤出现淡红色斑丘疹，瘙痒不已，耳后及枕部臀核肿大为其特征。因皮疹细小如沙，故又称“风痧”。